下列哪个标志的出现直接表明HBV在体内复制活跃，传染性强
A. HBsAg
B. HBcAg
C. HBeAg
D. DNA多聚酶
E. HBV DNA

正确答案：E。HBV DNA

解析：本题考查乙肝病毒复制和传染的直接标志。HBV DNA（E对ABCD错）是HBV复制和具有传染性的直接标志，HBV DNA定量检测对于确定HBV感染者的病毒复制水平具有重要的意义。